初产妇，28岁。孕足月临产后静脉滴注缩宫素，自然破膜1分钟后出现烦躁不安、呛咳、呼吸困难、发绀，数分钟后死亡。该患者最可能的诊断是
A. 子宫破裂
B. 重度胎盘早剥
C. 重度子痫前期
D. 子痫
E. 羊水栓塞

正确答案：E。羊水栓塞

解析：该青年初产妇，孕足月临产后静脉滴注缩宫素，自然破膜1分钟后（子宫收缩过强、胎膜破裂和宫颈或宫体损伤处有开放的静脉或血窦，是导致羊水栓塞发生的基本条件）出现烦躁不安，呛咳、呼吸困难发绀，数分钟后死亡（羊水栓塞起病急骤，多发生于分娩过程，尤其是刚破膜不久，产妇突感寒战，出现呛咳、气急、烦躁不安等前驱症状，继而出现呼吸困难、发绀、抽搐、昏迷，脉搏细数、血压急剧下降，严重者于数分钟内死亡），最可能的诊断是羊水栓塞（E对）。子宫破裂（P218）（A错）分为不完全性子宫破裂和完全性子宫破裂，不完全性子宫破裂是子宫肌层部分或全层破裂，但浆膜层完整，宫腔与腹腔不相通，胎儿及其附属物仍在宫腔内；完全性子宫破裂是子宫肌壁全层破裂，宫腔与腹腔相通，产妇突感下腹一阵撕裂样剧痛，子宫收缩骤然停止，无突然发生呛咳，呼吸困难发绀等症状。重度胎盘早剥（P131）（B错）胎盘剥离面超过胎盘面积1/2，临床表现为突发性持续腹痛，无阴道流血或阴道流血不多，可出现休克症状，且休克程度大多与母血丢失成比例，腹部检查见子宫硬如板状，宫缩间歇时不能松弛，胎位扪不清，胎心消失，无呼吸困难发绀以及数分钟内死亡等表现。重度子痫前期（P66）（C错）表现如下：①血压持续升高：收缩压≥160mmHg和（或）舒张压≥110mmHg；②蛋白尿≥5.0g/24h或随机蛋白尿≥（+++）；③持续性头痛或视觉障碍或其他脑神经症状；④持续性上腹部疼痛，肝包膜下血肿或肝破裂症状；⑤肝脏功能异常等。子痫（P66）（D错）是指子痫前期基础上发生不能用其他原因解释的抽搐，而该患者无子痫前期病史。